标准正态分布曲线下90％所对应的横轴尺度Z的范围是
A. -1.645到1.645
B. -∞到1.645
C. -∞到2.58
D. -1.96到1.96
E. -2.58到+∞

正确答案：A。-1.645到1.645

解析：本题考查正态分布的相关内容。正态分布曲线下的面积分布规律为：无论μ，σ取什么值，正态曲线与横轴间的面积总等于1。在μ±σ范围内，在μ±1.645σ（A对BCDE错）范围内曲线下的面积为90%。